非处方药遴选的主要原则
A. 防治必需、安全有效、价格合理、使用方便、中西药并重、基本保障、临床首选、基层能够
B. 临床必需、安全有效、价格合理、使用方便、市场能够保证供应
C. 安全、有效、方便、价廉
D. 应用安全、疗效确切、质量稳定、使用方便

正确答案：D。应用安全、疗效确切、质量稳定、使用方便

解析：本题考查的是非处方药的遴选原则。非处方药遴选的主要原则应用安全、疗效确切、质量稳定、使用方便（D对）。非处方药的遴选：为了配合药品分类管理制度的推行，我国于1999开始对非处方药进行遴选并公布非处方药目录。非处方药根据以下原则遴选：（1）应用安全：长期临床使用证实安全性大；无潜在毒性，不易引起蓄积中毒，中药中的重金属限量不超过国内或国外公认标准；基本无不良反应；不引起依赖性，无“三致”作用；医疗用毒性药品、麻醉药品以及精神药品原则上不能作为非处方药，但个别麻醉药品与少数精神药品可作为“限复方制剂活性成分”使用；组方合理，无不良相互作用，比如中成药组方中无“十八反”“十九畏”等。（2）疗效确切：药物作用针对性强，功能主治明确；不需要经常调整剂量；连续使用不引起耐药性。（3）质量稳定：质量可控、性质稳定。（4）使用方便：不用经过特殊检查和试验即可使用；以口服和外用的常用剂型为主。国家基本药物目录的制定：国家卫生健康委员会会同有关部门起草国家基本药物目录遴选工作方案和具体的遴选原则，经国家基本药物工作委员会审核后组织实施。国家基本药物遴选应当按照防治必需、安全有效、价格合理、使用方便、中西药并重、基本保障、临床首选和基层能够配备（A错）的原则，结合我国用药特点，参照国际经验，合理确定品种（剂型）和数量。国家基本药物应当是《中华人民共和国药典》收载的，国家卫生健康部门、国家药品监督管理部门颁布药品标准的品种。除急救、抢救用药外，独家生产品种纳入国家基本药物目录应当经过单独论证。医保药品目录的确定条件：根据《城镇职工基本医疗保险用药范围管理暂行办法》第三条，纳入医保药品目录的药品，应是临床必需、安全有效、价格合理、使用方便、市场能够保证供应（B错）的药品，并具备下列条件之一：《中华人民共和国药典》（现行版）收载的药品；符合国家药品监督管理部门颁发标准的药品；国家药品监督管理部门批准正式进口的药品。基本医疗卫生制度的建立：深化医药卫生体制改革是全面深化改革的重要内容，是维护人民群众健康福祉的重大民生工程、民心工程。2009年4月6日，《中共中央国务院关于深化医药卫生体制改革的意见》（中发〔2009〕6号）（以下简称“新医改意见”）发布，标志着我国医药卫生体制进入深化改革新阶段。新医改意见坚持把基本医疗卫生制度作为公共产品向全民提供的核心理念，坚持保基本、强基层、建机制的基本原则，首次明确了深化医药卫生体制改革总体目标是建立健全覆盖城乡居民的基本医疗卫生制度，为群众提供安全、有效、方便、价廉（C错）的医疗卫生服务。即建设覆盖城乡居民的公共卫生服务体系、医疗服务体系、医疗保障体系、药品供应保障体系，形成四位一体的基本医疗卫生制度。四大体系相辅相成，配套建设，协调发展。同时，完善保障医药卫生体系有效规范运转的体制机制，完善医药卫生的管理、运行、投入、价格、监管体制机制，建立协调统一的医药卫生管理体制、高效规范的医药卫生机构运行机制、政府主导的多元卫生投入机制、科学合理的医药价格形成机制、严格有效的医药卫生监管体制、可持续发展的医药卫生科技创新机制和人才保障机制、实用共享的医药卫生信息系统、医药卫生法律制度，保障医药卫生体系有效规范运转。